根据《关于禁止商业贿赂行为的暂行规定》，应以行贿或者受贿论处的行为有
A. 经营者销售商品，以明示方式给予对方折扣，且如实入账
B. 经营者销售商品，以明示方式给予对方现金，且未如实入账
C. 经营者购买商品时，接受对方以明示方式给予的实物，且未如实入账
D. 经营者购买商品时，接受对方以明示方式给予的折扣，且如实入账
E. 经营者销售商品，在账外暗中以实物方式退给对方单位一定比例的商品价款

正确答案：B、C、E。经营者销售商品，以明示方式给予对方现金，且未如实入账；经营者购买商品时，接受对方以明示方式给予的实物，且未如实入账；经营者销售商品，在账外暗中以实物方式退给对方单位一定比例的商品价款

解析：本题考查不正当竞争行为。根据《关于禁止商业贿赂行为的暂行规定》，应以行贿或者受贿论处的行为有经营者销售商品，以明示方式给予对方现金，且未如实入账（B对）；经营者购买商品时，接受对方以明示方式给予的实物，且未如实入账（C对）；经营者销售商品，在账外暗中以实物方式退给对方单位一定比例的商品价款（E对）。经营者的商业贿赂行为：经营者不得采用财物或者其他手段贿赂下列单位或者个人，以谋取交易机会或者竞争优势：①交易相对方的工作人员；②受交易相对方委托办理相关事务的单位或者个人；③利用职权或者影响力影响交易的单位或者个人。经营者在交易活动中，可以以明示方式向交易相对方支付折扣，或者向中间人支付佣金。经营者向交易相对方支付折扣、向中间人支付佣金的，应当如实入账（A错）。接受折扣、佣金的经营者也应当如实入账（D错）。经营者的工作人员进行贿赂的，应当认定为经营者的行为；但是，经营者有证据证明该工作人员的行为与为经营者谋取交易机会或者竞争优势无关的除外。